头孢曲松钠与乳酸钠林格注射液直接混合，可导致
A. 产生气体
B. 溶液变色
C. 产生微浑浊或沉淀
D. 产生胶状不溶物
E. 药物分解速度加快

正确答案：C。产生微浑浊或沉淀

解析：本题考查药物的配伍使用。头孢曲松钠与乳酸钠林格注射液直接混合，可导致微浑浊或沉淀（C对）。碳酸氢钠和大黄酚混合会产生气体（A错）二氧化碳。维生素C和烟酰胺配伍混合将会变色（B错）。红霉素静滴时若以氯化钠或含盐类的注射液溶解，产生胶状不溶物（D错）。青霉素钠用5%葡萄糖注射液溶解，可导致药物分解、降解速度加快（E错）。